患儿，男，6岁，发热3天，口腔颊黏膜近臼齿处出现微小灰白色斑点，周围绕以红晕，此为
A. 口疮
B. 麻疹将出之兆
C. 鹅口疮
D. 口糜
E. 口疔

正确答案：B。麻疹将出之兆

解析：口腔颊黏膜近臼齿处出现微小灰白色斑点，周围绕以红晕，是麻疹前期征兆（B对）。口腔内膜上出现黄白色如豆大、表浅的小溃疡点，周围红晕，局部灼痛者，为口疮，也称为”口糜“（AD错）。若小儿口腔、舌面满布片状白屑，状如鹅口者，为鹅口疮，又称“雪口”（C错）。如粟如芥，形小根深，周围有红肿根盘，为口疔（E错）。